患者，女，23岁。面部见蝶形红斑，关节肌肉酸痛，皮肤紫斑，烦躁口渴，神昏谵语，手足抽搐，大便秘结，小便短赤，舌红绛苔黄腻，脉洪数。其治法是
A. 清热祛风通络
B. 滋阴降火凉血
C. 清热活血熄风
D. 清热解毒凉血
E. 养肝熄风化瘀

正确答案：D。清热解毒凉血

解析：患者面部蝶形红斑，病为系统性红斑狼疮。热壅脉络，迫血妄行，故见关节肌肉酸痛，皮肤紫斑；热盛伤津，故见烦躁口渴，手足抽搐，大便秘结，小便短赤；热扰心神故见神昏谵语；舌红绛苔黄腻，脉洪数，均为热毒炽盛证的表现。治法为清热解毒，凉血化斑，方药选用清瘟败毒饮加减（D对）。清热祛风通络（A错）治疗风湿热痹症，代表方为白虎加桂枝汤加减。滋阴降火凉血（B错）治疗阴虚血热证。清热活血熄风（C错）治疗瘀热互结证。养肝熄风化瘀（E错）治疗阴虚风动，瘀血阻滞证。